在注射给药前，不必进行皮肤敏感试验的药品是
A. 降纤酶
B. 门冬酰胺酶
C. 玻璃酸酶
D. 尿激酶
E. 糜蛋白酶

正确答案：D。尿激酶

解析：本题考查药物的安全应用。在注射给药前，不必进行皮肤敏感试验的药品是尿激酶（D错，为本题正确答案）。有些药物在给药后容易引起过敏反应，出于用药安全考虑，需根据情况在给药前进行皮肤敏感试验，以确定阳性或阴性反应。尿激酶在注射前不必进行皮试。降纤酶（A对）、门冬酰胺酶（B对）、玻璃酸酶（C对）、糜蛋白酶（E对）都需在注射前进行皮试。